治疗中风语言不利，肾虚精亏证，应首选
A. 补阳还五汤
B. 血府逐瘀汤
C. 镇肝熄风汤
D. 地黄饮子
E. 牵正散

正确答案：D。地黄饮子

解析：地黄饮子用熟地黄、 山茱萸滋补肾阴，肉苁蓉、巴戟天温壮肾阳，配伍附子、肉桂之辛热，以助温养下元，摄纳浮阳，引火归元；石斛、麦冬、五味子滋养肺肾，金水相生；壮水以济火， 石菖蒲与远志、茯苓合用是开窍化痰，交通心肾的常用组合，姜、枣和中调药。诸药合用，使下元得以补养，浮阳得以摄纳，水火既济，痰化窍开，可治疗中风后遗症语言不利肾虚精亏证（D对）。补阳还五汤功能补气、活血、通络，为治疗中风半身不遂，脉络瘀阻证的选方（A错）。血府逐瘀汤功能祛瘀通脉，行气止痛，为治疗胸痹心血瘀阻证的选方（B错）。镇肝熄风汤功能补肝肾之阴，又能息风潜阳，为治疗中风中经络阴虚风动证的选方（C错）。牵正散功能祛风化痰，通络止痉，为治疗中风后遗症口眼斜证的选方，见第五版教材P212（E错）。